义齿基托的功能不包括
A. 连接义齿各部件成一整体
B. 承担传递分散（牙合）力
C. 修复缺损的软硬组织
D. 直接有效的固位作用
E. 间接固位作用

正确答案：D。直接有效的固位作用

解析：基托的功能：排列人工牙，连接义齿各部件成一个整体。承担、传递和分散人工牙承受的（牙合）力。修复缺损的牙槽骨、颌骨和软组织。利用基托与黏膜之间的吸附力，基托与基牙及邻近牙接触形成的摩擦力和约束力，加强义齿的固位与稳定。也有防止义齿旋转和翘动的间接固位作用。掌握“局部义齿人工牙及基托”知识点。